患者腹大胀满，按之如囊裹水，伴下肢水肿，胸脘痞胀，精神困倦，怯寒懒动，尿少便溏，舌苔厚腻，脉缓。其治法是
A. 温中健脾，行气利水
B. 温补脾肾，化气行水
C. 健脾益气，化气行水
D. 理气疏肝，化瘀利水
E. 健脾渗湿，行气利水

正确答案：A。温中健脾，行气利水

解析：题中患者以腹大胀满，按之如囊裹水为主症，故诊断为臌胀。由于脾阳不振，寒湿停聚，水蓄不行，故腹大胀满，按之如囊裹水；寒水相搏，中阳不运，故胸脘痞胀；脾为湿困，阳气失于舒展，故精神困倦，怯寒懒动；寒湿困脾，兼伤肾阳，水液不行，故尿少便溏，下肢水肿；舌苔厚腻，脉缓均是湿胜阳微之候。故辩证为臌胀水湿困脾证，治益温中健脾，行气利水（A对）。温补脾肾，化气行水，为臌胀阳虚水盛证的治法（B错）。健脾益气为脾气虚的治法，化气行水为水湿内停导致的气机运行不畅的治法（C错）。理气疏肝为肝气郁滞的治法，化瘀利水为水瘀互结的治法（D错）。健脾渗湿为脾虚湿胜的治法，行气利水为水湿内停的治法（E错）。